男，65岁，急性下壁心肌梗死第2天，心电监测示第二度Ⅰ型房室传导阻滞，心室率50次/分，血压110/70mmHg，治疗首选
A. 临时心脏起搏器植入
B. 肾上腺素
C. 直流电复律
D. 毛花甙丙（西地兰）
E. 阿托品

正确答案：E。阿托品

解析：患者老年男性，急性下壁心肌梗死伴二度Ⅰ型房室传导阻滞，心室率稍慢（50次/分），血压正常，此时使用阿托品（E对）可恢复心率以维持合适的血流动力学，从而改善患者的临床症状（九版药理学P65）。临时心脏起搏器植入（A错）适用于房室传导阻滞为二度或三度且伴有血流动力学障碍者，而本例患者心室率稍慢（50次/分），血压正常，故不作为首选治疗方案。对于房室传导阻滞的患者多可静脉滴注异丙肾上腺素治疗，而肾上腺素常用于治疗过敏性休克和心脏骤停（B错）。直流电复律（P208）（C错）主要适用于各种严重的、甚至危及生命的恶性心律失常以及各种持续时间较长的快速型心律失常。毛花甙丙（西地兰）（P175）（D错）最适合用于有快速心室率的心房颤动并心室扩大伴左心室收缩功能不全者，多用于急性左心衰竭的强心治疗。